提示胸腔手术后内出血的指征是引流管中每小时引流出血液量持续超过
A. 50ml
B. 100ml
C. 150ml
D. 200ml
E. 250ml

正确答案：B。100ml

解析：胸腔手术后从胸腔引流管内每小时引流出血液量持续超过100ml，就提示有内出血（B对）。